某男，35岁。风寒感冒4日，症见无汗头痛发热口渴无恶寒。医师诊为风寒郁于肌腠化热之证。处以柴葛解肌汤加减。方用柴胡、葛根、甘草、黄芩、羌活、白芷、白芍、桔梗等。药后诸症缓解。处方中葛根解肌退热生津止渴。其主要化学成分的结构类型是
A. 香豆素
B. 木脂素
C. 蒽醌
D. 黄酮
E. 生物碱

正确答案：D。黄酮

解析：本题考查的是葛根中的主要成分及其化学结构。处方中葛根解肌退热生津止渴。其主要化学成分的结构类型是黄酮（D对）。葛根含异黄酮类化合物，主要成分有大豆素、大豆苷、大豆素-7，4'-二葡萄糖苷及葛根素、葛根素-7-木糖苷。《中国药典》以葛根素为指标成分进行含量测定，要求含葛根素不得少于2.4%。香豆素（A错）邻羟基桂皮酸的内酯，广泛分布于高等植物中，尤其以芸香科和伞形科为多见，少数发现于动物和微生物中。含香豆素的常用中药有秦皮、前胡、肿节风、补骨脂等。在植物体内，它们往往以游离状态或与糖结合成苷的形式存在。木脂素（B错）类多数是游离的，也有少量与糖结合成苷而存在，由于较广泛地存在于植物的木部和树脂中，或开始析出时呈树脂状，故称木脂素。主要有五味子醇、五味子素、厚朴酚、和厚朴酚、连翘苷等。含木脂素类化合物的常用中药有五味子、厚朴、连翘、细辛等。蒽醌（C错）类成分包括蒽酮及其不同还原程度的产物。按母核可分为单蒽核及双蒽核，按氧化程度又可分为氧化蒽酚、蒽酮、蒽酚及蒽酮的二聚物。含蒽醌类化合物的常用中药有大黄、茜草、番泻叶等。生物碱（E错）类主要分布于植物界，在动物界中少有发现。生物碱绝大多数存在于双子叶植物中，已知有50多个科的120多个属中存在生物碱。与中药有关的典型的科有毛茛科（黄连属黄连，乌头属乌头、附子）、防己科（汉防己、北豆根）、罂粟科（罂粟、延胡索）、茄科（曼陀罗属洋金花、颠茄属颠茄、莨菪属莨菪）、马钱科（马钱子）、小檗科（三颗针）、豆科（苦参属苦参、槐属苦豆子）等。单子叶植物也有少数科属存在生物碱，如石蒜科、百合科（贝母属的川贝母、浙贝母）、兰科等。少数裸子植物如麻黄科、红豆杉科、三尖杉科和松柏科也存在生物碱。低等植物中仅发现极个别的存在生物碱，如烟碱存在于蕨类植物中，麦角生物碱存在于菌类植物中。地衣、苔藓类植物中仅发现少数简单的吲哚类生物碱。藻类、水生类植物中未发现生物碱。